患儿，男，4岁，体温39.1℃，诊断为上呼吸道感染，应用后有引起Reye's综合征风险的药物是
A. 双氯芬酸
B. 美洛昔康
C. 阿司匹林
D. 曲马多
E. 布洛芬

正确答案：C。阿司匹林

解析：本题考查阿司匹林。有引起Reye's综合征风险的药物是阿司匹林（C对）。发热基本上为对症治疗，可服用退热药物将体温降至正常。常用于退热的有对乙酰氨基酚和布洛芬，原则上单药治疗，如果一种药物不起效则换用另外一种，不建议合用或交替使用。如果一种药物服用后最小时间间隔还没到，患者又发热，可以用另外一种药物。阿司匹林避免用于儿童退热，可能引起Reye's综合征。